煤的主要杂质是
A. 氮化物
B. 硫化物
C. 铅化物
D. 含镉化合物
E. 砷化物

正确答案：B。硫化物

解析：本题考查煤的主要杂质。煤的主要杂质是硫化物（B对ACDE错），此外还有氟、砷、钙、铁、镉等。